患者，女，28岁。近2个月经量渐减，点滴即止，胸闷呕恶，带下量多，形体肥胖，舌淡苔白腻，脉滑。其诊断是
A. 月经过少血瘀证
B. 带下病脾虚证
C. 月经过少痰湿证
D. 月经过少阴虚证
E. 月经过少血虚证

正确答案：C。月经过少痰湿证

解析：患者近2个月经量渐减，点滴即止，属月经过少。痰湿内停，阻滞脉络，气血运行不畅，血海不足，故经量减少，色淡质黏腻。痰湿内阻，中阳不振，则形体肥胖，胸闷呕恶。痰湿下注，伤及冲、带二脉，故带下量多，舌淡苔白腻，脉滑均为痰湿之象（C对）。血瘀证的主要证候为经行涩少，色紫黯，有血块；小腹胀痛，血块排出后胀痛减轻，舌紫黯，有瘀点瘀斑，脉沉弦（A错）。带下病以带下量多，色、质、气味异常，或伴局部及全身症状者，患者无色质味的异常（B错）。肾阴亏虚，精血不足，冲任血海亏虚，出现经量减少，色黯淡，质稀伴腰膝酸软，头晕耳鸣，足跟痛，舌淡，脉沉弱（D错）。营血亏虚，冲任血海不盈，出现经量减少，或点滴即净，色淡，质稀，或小腹隐痛，头晕眼花，心悸怔忡，舌淡红，脉细（E错）。